关于药物吸收的说法，正确的是
A. 胃是被动吸收药物的主要吸收部位
B. 核黄素在十二指肠主动吸收，与促胃肠动力药同服时，其吸收会增加
C. 生物药剂学分类系统Ⅱ类药物具有低溶解性特点，可通过增加药物脂溶性改善吸收
D. 一般认为口服剂型的生物利用度顺序为：混悬液＞胶囊＞包衣片＞分散片
E. 难溶性酸性药物制成钠盐后可改善溶解度，其口服吸收会增加

正确答案：E。难溶性酸性药物制成钠盐后可改善溶解度，其口服吸收会增加

解析：本题考查药物吸收。提高难溶性药物除了粉末纳米化、使用表面活性剂外，还可采取制成盐或亲水性前体药物、固体分散体、环糊精包合物、磷脂复合物等方法提高溶出速度。难溶性药物制成盐可增加药物的溶解度，也可增加难溶性药物的吸收（E对）。